长期全胃肠外营养治疗一般采用的置管途径是
A. 股静脉
B. 大隐静脉
C. 贵要静脉
D. 锁骨下静脉
E. 小隐静脉

正确答案：D。锁骨下静脉

解析：对于超过两周的长期肠外营养，应经中心静脉导管输入，该导管常经颈内静脉、锁骨下静脉（D对）、头静脉或贵要静脉（根据九版外科学，C选项也为正确答案）置入。若短期肠外营养（＜2周），则采用周围静脉途径即浅表静脉，大多数是上肢末梢静脉，而股静脉（A错）、大隐静脉（B错）、小隐静脉（E错）均为下肢静脉。